鹅口疮心脾积热证的首选方剂是
A. 清胃散
B. 泻黄散
C. 泻心汤
D. 清热泻脾散
E. 导赤散

正确答案：D。清热泻脾散

解析：鹅口疮心脾积热证是由于秽毒蕴积心脾所致，灼伤舌口所致，治以清心泻脾，方药为清热泻脾散（D对）。清胃散（A错）其功用为清胃凉血，适用于胃火牙痛。泻黄散（B错）其功用为泻脾胃伏火，可用于小儿弄舌等症。泻心汤（C错）其功用为泻火消痞，适用于邪热壅滞下焦，气机痞塞证。导赤散（E错）其功用为清心利水养阴，适用于心经火热证。